《药品不良反应报告和监测管理办法》规定，负责制定药品不良反应报告管理规章和政策，并监督实施的部门是
A. 国家食品药品监督管理局
B. 国家食品药品监督管理局会同卫生部
C. 卫生部
D. 国家药品不良反应监测中心
E. 国务院卫生主管部门和地方各级卫生主管部门

正确答案：B。国家食品药品监督管理局会同卫生部

解析：本题考查《药品不良反应报告和监测管理办法》。《药品不良反应报告和监测管理办法》规定，负责制定药品不良反应报告管理规章和政策，并监督实施的部门是国家食品药品监督管理局会同卫生部（B对）。《药品不良反应报告和监测管理办法》第二章职责第六条：国家食品药品监督管理局（A错）负责全国药品不良反应报告和监测的管理工作，并履行以下主要职责：（一）与卫生部（C错）共同制定药品不良反应报告和监测的管理规定和政策，并监督实施；（二）与卫生部联合组织开展全国范围内影响较大并造成严重后果的药品群体不良事件的调查和处理，并发布相关信息；（三）对已确认发生严重药品不良反应或者药品群体不良事件的药品依法采取紧急控制措施，作出行政处理决定，并向社会公布；（四）通报全国药品不良反应报告和监测情况；（五）组织检查药品生产、经营企业的药品不良反应报告和监测工作的开展情况，并与卫生部联合组织检查医疗机构的药品不良反应报告和监测工作的开展情况。第十条：国家药品不良反应监测中心（D错）负责全国药品不良反应报告和监测的技术工作，并履行以下主要职责：（一）承担国家药品不良反应报告和监测资料的收集、评价、反馈和上报，以及全国药品不良反应监测信息网络的建设和维护；（二）制定药品不良反应报告和监测的技术标准和规范，对地方各级药品不良反应监测机构进行技术指导；（三）组织开展严重药品不良反应的调查和评价，协助有关部门开展药品群体不良事件的调查；（四）发布药品不良反应警示信息；（五）承担药品不良反应报告和监测的宣传、培训、研究和国际交流工作。